为增强补脾、润肺、益肾功能，并除去麻味，宜选用蒸法炮制的中药是
A. 黄精
B. 人参
C. 天麻
D. 黄芩
E. 何首乌

正确答案：A。黄精

解析：本题考查的是黄精的炮制作用。为增强补脾、润肺、益肾功能，并除去麻味，宜选用蒸法炮制的中药是黄精（A对）。黄精：【炮制作用】黄精味甘，平。归脾、肺、肾经。具有补气养阴、健脾、润肺、益肾的功能。生黄精具麻味，刺激咽喉。蒸后补脾润肺益肾功能增强，并可除去麻味，以免刺激咽喉。用于肺虚燥咳，脾胃虚弱，肾虚精亏。酒黄精能助其药势，使之滋而不腻，更好地发挥补益作用。人参（B错）：【炮制作用】人参性味甘、微苦，微温。归脾、肺、心、肾经。具有大补元气、复脉固脱、补脾益肺、生津养血、安神益智的功能。①生晒参偏于补气生津，复脉固脱，补脾益肺，用于体虚欲脱，肢冷脉微，脾虚食少，肺虚喘咳，津伤口渴，内热消渴，气血亏虚，久病虚羸，惊悸失眠，阳痿宫冷。②红参性味甘、微苦，温。归脾、肺、心、肾经。具有大补元气、复脉固脱、益气摄血的功能。用于体虚欲脱，肢冷脉微，气不摄血，崩漏下血。天麻（C错）：【炮制作用】天麻味甘，性平。归肝经。具有息风止痉，平抑肝阳，祛风通络的功能。用于小儿惊风，癫痫抽搐，破伤风，头痛眩晕，手足不遂，肢体麻木，风湿痹痛。蒸天麻主要是为了便于软化切片，同时可破坏酶，保存苷类成分。黄芩（D错）：【炮制作用】黄芩性味苦寒。归肺、胆、脾、胃、大肠、小肠经。具有清热燥湿、泻火解毒、止血、安胎的功能。黄芩蒸或沸水煮的目的是灭活酶，防止苷类成分分解，以保存药效，又能使药物软化，便于切片。①生黄芩清热泻火解毒力强，用于热病，湿温，黄疸，泻痢、乳痈发背。②酒黄芩入血分，并可借黄酒升腾之力，用于上焦肺热及四肢肌表之湿热；同时，因酒性大热，可缓和黄芩的苦寒之性，以免伤害脾阳，导致腹泻。③黄芩炭以清热止血为主，用于崩漏下血，吐血衄血。何首乌（E错）：【炮制作用】何首乌味苦、甘、涩，性温。归肝、心、肾经。①生何首乌苦泄性平兼发散，具有解毒消肿、润肠通便、截疟的功能。用于瘰疬疮痈，风疹瘙痒，肠燥便秘，久疟不止，高脂血症。②制何首乌味转甘厚而性转温，增强了补肝肾、益精血、乌须发、强筋骨的作用，用于血虚萎黄，眩晕耳鸣，须发早白，腰膝酸软，肢体麻木，崩漏带下，久疟体虚，高脂血症。同时消除了生何首乌滑肠致泻的副作用，使慢性病患者长期服用而不造成腹泻。